回力卡环适用于
A. 前牙缺失
B. 间隔缺失
C. 后牙游离缺失
D. 后牙非游离缺失
E. 个别牙缺失

正确答案：C。后牙游离缺失

解析：本题考查回力卡环的适应证。回力卡环适用于后牙游离端缺失（C对）。由于远中支托不与基托或连接杆相连，力通过人工牙和基托首先传导到基托下黏膜和骨组织，可减轻基牙受力，起到应力中断的作用。前牙缺失（A错）、个别牙缺失用（E错）简单圆环形卡环。 牙齿间隔缺失（B错）用对半卡环。后牙非游离缺失（D错）用圈形卡环。